毛果芸香碱临床用于
A. 有机磷中毒
B. 术后腹胀气
C. 青光眼
D. 扩瞳验光
E. 抗休克

正确答案：C。青光眼